当水中的氨含量较多时，加氯量与余氯的关系为
A. 当出现余氯后，随加氯量的增加，余氯量逐渐上升，但产生的是游离氯
B. 只有在原水的折点后，随着加氯量的增加，余氯量上升，形成的余氯全部为化合氯
C. 当出现余氯后，随加氯量的增加，余氯量逐渐上升，但产生的是化合氯
D. 在加氯量投入过程中，随着加氯量的增加，水中余氯会有化合性余氯增加——化合性余氯恒定——游离性余氯增加的一系列变化
E. 在加氯量投入过程中，随着加氯量的增加，水中余氯会有游离性余氯增加——游离性余氯减少——化合性余氯增加的一系列变化

正确答案：C。当出现余氯后，随加氯量的增加，余氯量逐渐上升，但产生的是化合氯

解析：本题考查水中有氨时余氯量与加氯量的关系。当水中的氨含量较多时，加氯量与余氯的关系为：在出现余氯后，随着加氯量的增加，余氯量逐渐上升，但产生的是化合氯（C对ABDE错）。